内脏大神经发自交感干的
A. 颈部
B. 胸部
C. 腰部
D. 胸腰部
E. 骶部

正确答案：B。胸部

解析：内脏大神经由穿过第5或第6-9胸交感干神经节的节前纤维组成，向前下方行走中合成一干（B对）。